女，68岁。反复咳嗽、咳痰20年，气喘10年，加重伴下肢水肿一周入院。高血压病史10余年，145/90mmHg。查体：T37.8℃，口唇发绀，血压135/80mmHg，双下肺散在湿啰音和哮鸣音，肝肋下3厘米，肝颈静脉回流征阳性，双下肢水肿。WBC9.3×10⁹/L，N0.78。符合该患者ECG表现是
A. 普遍导联ST段弓背向上抬高
B. 电轴左偏
C. P波增宽有切迹
D. 胸前导联顺钟向转位
E. Ⅱ，Ⅲ，AVF，ST-T改变

正确答案：D。胸前导联顺钟向转位

解析：该患者反复咳嗽、咳痰20年（为慢阻肺的典型表现），首先考虑为慢阻肺。现出现口唇发绀，双肺湿啰音和哮鸣音，肝颈静脉回流征阳性，下肢水肿等体征，出现了右心衰竭的症状和体征，符合肺源性心脏病典型体（P111）的诊断。肺心病的ECG（心电图检查）中常会出现重度顺钟向转位表现（D对）。普遍ST段弓背向上抬高（A错）通常为ST段抬高型心肌梗死急性期典型表现（P237），肺心病一般不会造成右心梗死，故普遍导联ST段弓背向上抬高不太可能出现在肺心病ECG中。肺心病心电图检查中电轴一般右偏（P112），而不是左偏（B错）。P波增宽有切迹常见于左心房肥大（九版诊断学P494），而肺心病一般只影响右心房，基本不会造成左心房肥大，因此其ECG极少出现P波增宽有切迹的情况（C错）。Ⅱ，Ⅲ，aVF，ST-T改变常见于心脏下壁梗死（P238），肺心病通常不会造成心脏下壁梗死，因此其ECG中通常不会有Ⅱ，Ⅲ，aVF，ST-T改变（E错）。